血压高于多少时应先治疗后拔牙
A. 120/80mmHg
B. 130/85mmHg
C. 140/85mmHg
D. 160/90mmHg
E. 180/100mmHg

正确答案：E。180/100mmHg

解析：本题考查高血压对牙拔除术的影响及拔牙禁忌证。拔牙手术的激惹必然会造成血压的骤然升高，如术前血压较高，可能导致高血压脑病或脑血管意外等危象。如血压高于180／100mmHg（E对）时应先治疗后拔牙。